在我国成年人中引起原发性肾病综合征最常见的病理类型是
A. 微小病变型肾病
B. 系膜增生性肾炎
C. 系膜毛细血管性肾炎
D. 膜性肾病
E. 局灶性节段性肾小球硬化

正确答案：D。膜性肾病

解析：膜性肾病（膜性肾小球病）（D对）是我国成年人中引起原发性肾病综合征最常见的病理类型。微小病变性肾病是我国儿童中引起原发性肾病综合征最常见的病理类型（A错）。系膜增生性肾炎（B错）、系膜毛细血管性肾炎（膜增生性肾小球肾炎）（C错）和局灶性节段性肾小球硬化（E错）均能引起原发性肾病综合征，多见于青少年。